女，35岁，人流术后闭经1年余，孕激素试验和雌孕激素序贯试验均阴性，体温监测为双相型，最可能的是
A. 下丘脑性闭经
B. 垂体性闭经
C. 子宫性闭经
D. 卵巢性闭经
E. 大脑皮层功能失调性闭经

正确答案：C。子宫性闭经

解析：子宫性闭经 闭经原因在子宫，继发性子宫性闭经的病因包括感染 创伤导致宫腔粘连引起的闭经，月经调节功能正常，第二性征发育也正常。 Asherman 综合征：为子宫性闭经最常见原因 多因人工流产刮宫过度或产后、流产后出血刮宫损伤子宫内膜，导致宫腔粘连而闭经（C对）。